用于治疗新生儿出血症的药物是
A. 维生素A醋酸酯
B. 维生素B₁
C. 维生素K₃
D. 维生素B₂
E. 维生素B₆

正确答案：C。维生素K₃

解析：本题考查各型维生素的临床作用。用于治疗新生儿出血症的药物是维生素K₃（C对）。维生素K₃属于促凝血药，可以用于治疗维生素K缺乏所引起的出血性疾病。维生素A醋酸酯（A错）可用于治疗维生素A缺乏症，如夜盲。维生素B₁（B错）主要用于维生素B₁缺乏的预防和治疗，如“脚气病”，周围神经炎及消化不良。维生素B₂（D错）可用于治疗维生素B₂缺乏症，症状表现为咽喉炎和口角炎，舌炎、唇炎（红色剥脱苔）、面部脂溢性皮炎。维生素B₆（E错）可用于治疗维生素B₆缺乏症，维生素B₆缺乏表现在皮肤和中枢神经系统，可产生眼、鼻和口部皮肤脂溢样皮肤损害，糙皮病。